已知暴露因素，研究健康效应常可采用的研究方法
A. 病例对照调查
B. 动物实验研究
C. 现况调查研究
D. 定群研究和现况调查研究
E. 队列研究

正确答案：D。定群研究和现况调查研究

解析：本题考查环境流行病学研究的方法。环境流行病学研究方法通常采用描述性（包括生态和现况）研究、分析性（病例-对照、定群）研究、实验流行病学的研究方法。需根据环境流行病学研究的内容选用不同的流行病学方法，如已知暴露因素，研究健康效应常可采用现况研究和定群研究（D对ABCE错）。